把缓控释片嚼碎或研碎服用属于
A. 剂型差错
B. 重复用药
C. 速率差错
D. 用法差错
E. 配置差错

正确答案：D。用法差错

解析：本题考查缓控释片的正确使用。缓控释片一般应整片或整丸吞服，严禁嚼碎和击碎分次服用，属于用药方法错误（D对）。剂型差错（A错）包括不经处方者同意而将片剂粉碎。重复用药（B错）见于同时服用含相同西药成分的中成药。速率差错（C错）见于静滴。配置差错（E错）指药物在溶解或稀释时发生错误，或发生配伍变化。